粘膜下注射疗法适用于
A. 三期内痔
B. 混合痔
C. 直肠息肉
D. 二、三度脱肛
E. 一、二度脱肛

正确答案：E。一、二度脱肛

解析：黏膜下注射法分为黏膜下层点状注射法和柱状注射法两种，适用于Ⅰ、Ⅱ度脱肛，以Ⅰ度脱肛效果最好（E对）。三期内痔可用注射疗法、贯穿结扎法治疗（A错）。混合痔根据内、外痔的程度采取内、外痔的疗法，必要时可选用外痔剥离、内痔结扎术（B错）。直肠息肉根据程度可采用灌肠法、结扎法、套扎法、直肠结肠切除术等疗法进行治疗（C错）。直肠周围注射法适用于Ⅱ、Ⅲ度脱肛（D错）。